可发生心肌向心性肥大的疾病是
A. 心肌炎
B. 高血压病
C. 二尖瓣关闭不全
D. 甲亢
E. 心肌中毒

正确答案：B。高血压病

解析：长期存在心肌损伤或负荷增加时，心脏通过心室重塑代偿。心肌肥大属于心室重塑的一种，分为向心性肥大和离心性肥大。高血压病（B对）时，体循环阻力增加，心脏后负荷过重，导致心肌肌节呈并联性增生，心肌细胞增粗，表现为心室壁显著增厚而心腔容积正常或减小，称为向心性肥大。二尖瓣关闭不全（C错）、甲亢（D错）均使心脏前负荷过重，导致心脏离心性肥大。心肌炎（A错）、心肌中毒（E错）时，心肌细胞变性坏死，导致心肌收缩性降低，不会发生向心性肥大。